突发公共卫生事件的分级包括
A. 特别重大、重大、较大和一般四级
B. 重大、较大和一般三级
C. 黄色预警、橙色预警和红色预警三级
D. 蓝色预警、黄色预警、橙色预警和红色预警四级
E. 特别严重、较严重和一般三级

正确答案：A。特别重大、重大、较大和一般四级

解析：本题考查突发公共卫生事件的分级。从突发公共卫生事件的性质、危害程度、涉及范围这些角度出发，可以将突发公共卫生事件划分为特别重大（Ⅰ级）、重大（Ⅱ级）、较大（Ⅲ级）和一般（Ⅳ级）四级（A对BCDE错）。